牙周炎的局部促进因素是
A. 微生物
B. 吸烟
C. 糖尿病
D. 刷牙
E. 牙石

正确答案：E。牙石

解析：凡是能加重菌斑滞留的因素，如牙石、不良修复体、食物嵌塞、牙排列不齐、解剖形态的异常等，均可成为牙周炎的局部促进因素。掌握“慢性牙周炎的病因，表现诊断及预后”知识点。